在疟疾流行区，作病因性预防应选用下列哪种方案
A. 乙胺嘧啶+伯氨喹
B. 氯喹+伯氨喹
C. 乙胺嘧啶+氯喹
D. 氯喹
E. 伯氨喹

正确答案：C。乙胺嘧啶+氯喹

解析：本题考查药物的联合应用。在疟疾流行区，作病因性预防应选用乙胺嘧啶+氯喹（C对）。乙胺嘧啶半衰期长，作用持久，临床用于疟疾的病因性预防，同时应用氯喹，其药效强大，能迅速控制疟疾症状的发作，对恶性疟有根治作用，是控制疟疾症状的首选药，因此两药合并为病因性预防疟疾的首选药。乙胺嘧啶+伯氨喹（A错）可产生协同作用，既能减少药量，又能加快杀灭疟原虫速度，此方多用于根治疟疾。氯喹+伯氨喹（B错）为疟疾最为常用的治疗方案。氯喹（D错）临床主要用于控制疟疾的急性发作和根治恶性疟。伯氨喹（E错）为控制复发和阻止疟疾传播的首选药。